急性肾小管坏死时引起肾血管收缩的原因中不包括
A. 儿茶酚胺增多
B. 肾素分泌减少
C. 内皮素释放增多
D. NO释放减少
E. 肾素一血管紧张素系统激活

正确答案：B。肾素分泌减少

解析：肾皮质血管收缩的机制主要与以下因素有关：(1)交感－肾上腺髓质系统兴奋：在ATN时，因有效循环血量减少或毒物的作用，致使交感－肾上腺髓质系统兴奋，血中儿茶酚胺水平升高（A对），通过刺激α-肾上腺素受体使肾血管收缩，肾血流量减少，GFR降低。(2) 肾素－血管紧张素系统激活（E对）：肾素产生增多（B错，为本题正确答案），促使肾内血管紧张素I(angiotensin, AngI)生成增加，引起入球小动脉及出球小动脉收缩。因肾皮质中的肾素含量丰富，故RAS系统激活，致使肾皮质缺血更甚。(3)肾内收缩及舒张因子释放失衡：肾缺血或肾中毒使肾血管内皮细胞受损，可引起血管内皮源性收缩因子（如内皮素， ET )分泌增多（C对）以及血管内皮源性舒张因子（如一氧化氮，NO)释放减少（D对）。